肾上腺素的杂质检查项目是
A. 中性或碱性物质
B. 酮体
C. 对氨基苯甲酸
D. 亚硫酸盐和可溶性淀粉
E. 其它生物碱

正确答案：B。酮体

解析：本题考查药物中杂质的检查。肾上腺素的杂质检查项目是酮体（B对）。肾上腺素等苯乙胺类拟肾上腺素等药物，其生产过程均存在酮体氢化还原制备工艺。若氢化不完全，易引入酮体杂质，影响药品质量。为此，中国药典对于有关苯乙胺类拟肾上腺素药物，规定检查相应的合成工艺杂质酮体。